不是朊粒的主要特点是
A. 引起人和动物中枢神经退化性病变
B. 内含糖基化磷脂酰肌醇
C. 是蛋白酶抗性蛋白
D. 不含核酸且不能复制
E. 具有传染性

正确答案：D。不含核酸且不能复制

解析：朊粒（prion）又称朊毒体，是引起人和动物发生传染性海绵状脑病的病原体，属于一类特殊的传染性蛋白粒子。朊粒的主要成分是蛋白酶抗性蛋白，分子量小为27～30kDa，内含糖基化磷脂酰肌醇（GPI）成分，但不含核酸，不含核酸却能复制。掌握“朊粒”知识点。